制备普通脂质体的材料是
A. 明胶与阿拉伯胶
B. 西黄蓍胶
C. 磷脂与胆固醇
D. 聚乙二醇
E. 半乳糖与甘露糖

正确答案：C。磷脂与胆固醇

解析：本题考查脂质体。脂质体的膜材主要由磷脂与胆固醇（C对）构成，这两种成分是形成脂质体双分子层的基础物质。磷脂类包括卵磷脂、脑磷脂、大豆磷脂以及其他合成磷脂。明胶与阿拉伯胶（A错）为天然高分子囊材。聚乙二醇（D错）常用于长循环脂质体，能够增加脂质体的柔顺性和亲水性，从而降低与单核巨噬细胞的亲和力，延长作用时间。